与面神经有关的神经核
A. 动眼神经副核
B. 下泌涎核
C. 下橄榄核
D. 孤束核
E. 上泌涎核

正确答案：D。孤束核

解析：孤束核（D对），小的上部属特殊内脏感觉核，接受经面神经、舌咽神经和迷走神经传入的味觉初级纤维；动眼神经副核（A错）调节晶状体的曲度和缩小瞳孔；下泌涎核（B错）发出副交感神经的节前纤维进入 舌咽神经，经其分支岩小神经至耳神经节换元，节后纤维管理腮腺的分泌；下橄榄核（C错）可能是大脑皮质、红核等与小脑之间纤维联 系的重要中继站，参与小脑对运动的调控；上泌涎核（E错）其副交感神经节后纤维管理 泪腺、下颌下腺、舌下腺以及口、鼻腔黏膜腺的分泌。